《温热论》中所云“益胃”法是指
A. 清气生津，宣展气机
B. 补养胃气
C. 和胃降逆
D. 轻清宣气
E. 透热转气

正确答案：A。清气生津，宣展气机

解析：益胃是指以轻清之品，清气生津，宣展气机（A对），并灌溉汤液，以振奋正气，气机宣透，腠理开泄，邪气随汗外透。